有关后牙3/4冠的牙体预备，下列叙述正确的是
A. 邻沟可预备在邻面舌侧1/3与中1/3交界处
B. 牙尖正常时，冠的（牙合）边缘一定要覆盖颊、舌尖
C. 可在舌侧（牙合）缘嵴外形成小斜面或小肩台
D. 必要时可在邻面增加邻沟数目，或在（牙合）面增加钉洞固位型
E. （牙合）沟预备是为防止修复体牙合向脱位

正确答案：D。必要时可在邻面增加邻沟数目，或在（牙合）面增加钉洞固位型

解析：本题考查后牙3/4冠的牙体预备。有关后牙3/4冠的牙体预备，下列叙述正确的是必要时可在邻面增加邻沟数目，或在（牙合）面增加钉洞固位型（D对）。为增强后牙3/4冠的固位力，在牙体预备过程中，必要时可在邻面增加邻沟数目，或在（牙合）面增加钉洞固位型。后牙3/4冠的邻沟可预备在邻面颊侧1/3与中1/3交界处（A错），是在颊侧而不是在舌侧。冠的（牙合）边缘应终止于（牙合）边缘嵴稍下以保护牙尖，牙尖正常时冠的（牙合）边缘也可不覆盖颊、舌尖（B错）。可在颊侧（牙合）缘嵴外形成小斜面或小肩台（C错），是在颊侧而不是舌侧。（牙合）沟预备是为防止修复体舌向脱位（E错）而不是（牙合）向脱位。